头孢曲松不能与含钙药物同时静脉给药的原因是
A. 诱导细菌对前者的耐药
B. 易发生交叉过敏反应
C. 两种药物会形成复合物沉淀
D. 促进前者在肝脏的代谢
E. 阻止后者在肾脏被灭活

正确答案：C。两种药物会形成复合物沉淀

解析：本题考查头孢曲松注意事项。为避免在肺或肾中形成头孢曲松-钙盐沉淀（C对），造成致命性危害，头孢曲松不能与含钙药品同时静脉给药。